以夏科（Charcot）三联征为典型表现的疾病是
A. 急性憩室炎
B. 急性出血性胰腺炎
C. 急性胆管炎
D. 十二指肠憩室
E. 胃溃疡

正确答案：C。急性胆管炎

解析：以夏科（Charcot）三联症为典型表现的疾病是急性胆管炎（C对）。急性憩室炎典型表现为局部压痛、发热，但无黄疸（A错）。急性出血性胰腺炎（P457）的典型表现是腹痛（多为饱食或饮酒后突然发作）、腹胀、恶心呕吐、腹膜炎体征（B错）。十二指肠憩室（P352）绝大多数无临床症状，一般无寒战高热和黄疸（D错）。胃溃疡不会出现黄疸（E错）。